以下哪种疾病是根据龋病的进展速度进行分类的
A. 慢性龋
B. 平滑面龋
C. 深龋
D. 浅龋
E. 隐匿性龋

正确答案：A。慢性龋

解析：根据病变的进展速度分类，有利于对患者的整体情况综合考虑，有利于及时采取有针对性的治疗和干预措施。具体分为慢性龋、急性龋、静止龋。掌握“龋病的临床表现与分类”知识点。